皮下脂肪瘤常见的肉眼特点
A. 息肉状
B. 乳头状
C. 分叶状
D. 结节状
E. 囊状

正确答案：C。分叶状

解析：皮下脂肪瘤是起源于间叶组织的良性肿瘤，肉眼观常呈分叶状（C对）。肉眼观呈乳头状（B错）多为乳头状瘤（P96）。肉眼观呈息肉状（A错）多为黏膜的腺瘤；呈结节状（D错）多为腺器官内的腺瘤。肉眼观呈囊状（E错）多为囊腺瘤（P97）。